参与膝跳反射
A. 闭孔神经
B. 腓总神经
C. 股神经
D. 胫神经
E. 坐骨神经

正确答案：C。股神经

解析：股神经（C对）在股三角内发出数条分支，其中肌支主要分布于髂肌、耻骨肌、股四头肌和缝匠肌，参与膝跳反射。